红细胞谷胱甘肽还原酶活性系数测定是评价哪种维生素营养状况的指标
A. 维生素B₁
B. 维生素B₂
C. 维生素C
D. 维生素D
E. 维生素A

正确答案：B。维生素B₂